典型霍乱患者，发病后最先出现的常见症状是
A. 畏寒，发热
B. 剧烈腹泻，继之呕吐
C. 声嘶
D. 腓肠肌痉挛
E. 腹部绞痛

正确答案：B。剧烈腹泻，继之呕吐

解析：霍乱的病原菌为霍乱弧菌，潜伏期1～3天（数小时～5天），多为突然发病，发病后最先出现的常见症状是剧烈腹泻（是发病的第一个症状），继之呕吐（B对），特点是无发热（A错）、无里急后重、多数不伴有腹痛（E错），病程中期可因钠盐大量丢失而导致低钠，从而引起腓肠肌痉挛（D错）和腹直肌痉挛。霍乱时患者无声嘶症状（C错），狂犬病时严重的咽喉肌痉挛可导致声嘶（P315）。